金属嵌体的洞缘应预备成
A. 刃状或羽状肩台
B. 宽0.5～1mm，45°斜面
C. 宽1.0mm，成直角或135°凹面的肩台
D. 宽0.3mm，45°～50°的小斜面
E. 宽0.5～0.8mm，呈浅凹形或圆角的肩台

正确答案：B。宽0.5～1mm，45°斜面

解析：本题考查金属嵌体的洞缘预备。金属嵌体的洞缘应预备成宽0.5～1mm，45°斜面（B对）。金属嵌体的洞缘应制备成宽0.5～1mm，45°的短斜面。刃状边缘一般用于倾斜牙的倾斜面（A错）。金属烤瓷全冠的肩台可制备成宽1.0mm，成直角或135°的凹面肩台，或在肩台的外缘形成宽0.3mm，45°～60°的小斜面（CD错）。铸造金属全冠的肩台应制备成宽0.5～0.8mm，呈浅凹形或圆角的肩台（E错）。